（119～121共用题干）男，45岁。8个月前骑电动车时摔倒，上腹部被车把撞伤并疼痛，经治疗后缓解。6个月前觉上腹部逐渐隆起，伴上腹饱胀，近日来常恶心、呕吐。查体：上腹部可触及直径约10cm包块，无肌紧张、压痛、反跳痛。应首选的检查是
A. 腹部CT
B. 腹部B超
C. 立位腹部X线平片
D. 腹部MRI
E. 胃镜

正确答案：B。腹部B超

解析：该患者8个月前有撞伤史（上腹部创伤均应考虑胰腺损伤的可能），6个月前觉上腹部逐渐隆起（胰腺假性囊肿易漏诊），伴上腹饱胀，近日来常恶心、呕吐。上腹部可触及直径约10cm 包块，影像学检查提示该患者上腹部10cm×10cm囊性肿物，综合患者的病史、临床变现和影像学检查，应诊断为胰腺假性囊肿。超声（B对）可发现胰腺回声不均和周围积血积液，且经济、方便，为首选检查。胃镜（E错）是食管、胃、十二指肠疾病的重要检查手段，对诊断胰腺疾病意义不大。腹部CT（A错）、立位腹部X线平片（C错）、腹部MRI（D错）对胰腺疾病有一定的诊断意义，但不作为首选检查。